咯血与呕血有鉴别意义的是
A. 血量
B. 血的颜色
C. 便潜血
D. 血的酸碱反应
E. 有无柏油样便

正确答案：D。血的酸碱反应